正确脑出血手术治疗的适应症是
A. 小脑血肿＞10ml、壳核出血大于40ml、中脑出血
B. 壳核出血大于40ml、额叶出血、脑桥出血
C. 小脑血肿＞10ml、延髄出血、严重脑室出血
D. 脑桥出血、额叶出血、严重脑室出血
E. 小脑血肿＞10ml、壳核出血大于40ml、严重脑室出血

正确答案：E。小脑血肿＞10ml、壳核出血大于40ml、严重脑室出血

解析：根据手术适应症①基底核区中等量以上出血（壳核出血≥30ml，丘脑出血≥15ml）；②小脑出血≥10ml或直径≥3cm，或合并明显脑积水；③重症脑室出血（脑室铸型）；④合并脑血管畸形、动脉瘤等血管病变。可判断本题E为脑出血手术治疗的适应症（E对）。